心衰患者出现夜间阵发性呼吸困难，其产生的机制是
A. 夜间周围血管紧张性增高
B. 神经反射的敏感性增高
C. 迷走神经相对抑制
D. 平卧时水肿液吸收入血减少
E. 平卧后胸腔容积减少不利于通气

正确答案：E。平卧后胸腔容积减少不利于通气

解析：心衰患者夜间入睡后，①迷走神经相对兴奋（C错），周围血管紧张性降低（A错），小支气管收缩，气道阻力增大。②平卧位时，下半身静脉血液回流不受重力影响，因而回流增多，使得水肿液吸收入血增多（D错），加重肺淤血。③平卧时膈肌上移，胸腔容积减少不利于通气（E对）。④入睡后神经反射的敏感性降低（B错），只有当肺淤血严重到使动脉血氧分压降低明显时，方能刺激呼吸中枢，使患者感到呼吸困难而惊醒。